重症肌无力胆碱能危象是由于
A. 抗胆碱酯酶活性消失
B. 抗胆碱酯酶药物用量不足
C. 抗胆碱酯酶药物作用突然消失
D. 抗胆碱酯酶药物过量
E. 抗胆碱酯酶药物过敏

正确答案：D。抗胆碱酯酶药物过量

解析：胆碱能危象是指重症肌无力患者由于抗胆碱酯酶药物过量（D对）所致，患者出现肌无力加重，并且出现明显胆碱酯酶抑制剂的不良反应如肌束颤动及毒蕈碱样反应。抗胆碱酯酶活性消失（A错）、抗胆碱酯酶药物用量不足（B错）、抗胆碱酯酶药物作用突然消失（C错）可致肌无力危象。抗胆碱酯酶药物过敏（E错）会导致过敏反应。